某女，85岁，因肺肾阴亏导致潮热盛汗，咽干咳血、眩晕耳鸣，腰膝酸软，消渴。宜选用的成药是
A. 麦味地黄丸
B. 青娥丸
C. 大补阴丸
D. 六味地黄丸
E. 杞菊地黄丸

正确答案：A。麦味地黄丸

解析：本题考查麦味地黄丸的主治。宜选用的成药是麦味地黄丸（A对）。麦味地黄丸【主治】肺肾阴亏，潮热盗汗，咽干咳血，眩晕耳鸣，腰膝酸软，消渴。青娥丸（B错）【主治】肾虚腰痛，起坐不利，膝软乏力。大补阴丸（C错）【主治】阴虚火旺，潮热盗汗，咳嗽咯血，耳鸣遗精。六味地黄丸（D错）【主治】肾阴亏损，头晕耳鸣，腰膝酸软，骨蒸潮热，盗汗遗精，消渴。杞菊地黄丸（E错）（片、浓缩丸、口服液、胶囊）【主治】肝肾阴亏，眩晕耳鸣，羞明畏光，迎风流泪，视物昏花。